关于失眠的说法，正确的有
A. 失眠继发于或伴发于其他疾病时，应同时治疗原发或伴发疾病
B. 长期性、难治性失眠应在精神专科医生指导下用药
C. 对于长期使用镇静催眠药物的慢性失眠患者，不提倡间歇治疗
D. 原发性失眠首选短效非苯二氮䓬类药物，如唑吡坦、佐匹克隆和扎来普隆
E. 苯二氮䓬受体激动剂或褪黑素受体激动剂可以与抗抑郁药联合应用

正确答案：A、B、D、E。失眠继发于或伴发于其他疾病时，应同时治疗原发或伴发疾病；长期性、难治性失眠应在精神专科医生指导下用药；原发性失眠首选短效非苯二氮䓬类药物，如唑吡坦、佐匹克隆和扎来普隆；苯二氮䓬受体激动剂或褪黑素受体激动剂可以与抗抑郁药联合应用

解析：本题考查抗失眠药物治疗策略。目前推荐的抗失眠药物治疗策略为：①失眠继发于或伴发于其他疾病时，应同时治疗原发或伴发疾病（A对）；②药物治疗开始后应监测并评估患者的治疗反应，长期性、难治性失眠应在专科医生指导下用药（B对）；③原发性失眠首选短效non-BZDs，如唑吡坦、佐匹克隆、右佐匹克隆和扎来普隆（D对）；④如首选药物无效或无法依从，更换为另一种短效或中效的BZRAs或者褪黑素受体激动剂；BZRAs或褪黑素受体激动剂可以与抗抑郁药联合应用（E对）；⑤对于长期应用镇静催眠药物的慢性失眠患者，不提倡药物连续治疗，建议采用间歇治疗或按需治疗的服药方式（C错）。